硝酸甘油最常用于心绞痛的急性发作，因它首先而且主要产生下列哪项作用
A. 降低心室容积
B. 降低室壁张力
C. 扩张静脉
D. 扩张小动脉
E. 降低耗氧量

正确答案：C。扩张静脉

解析：本题考查硝酸甘油。硝酸甘油最常用于心绞痛的急性发作，因它首先而且主要产生扩张静脉作用（C对）。硝酸甘油进入平滑肌细胞可分解为NO，增加cGMP的生成，使钙离子从细胞释放而松弛平滑肌，扩张冠状动脉和侧支循环血管，增加缺血区域的血流供应，缓解心绞痛。